主动脉瓣关闭不全杂音可传导至
A. 颈部和锁骨上窝
B. 左腋下和肩胛下区
C. 胸骨左缘和心底部
D. 胸骨左缘和心尖部
E. 心尖部

正确答案：D。胸骨左缘和心尖部

解析：主动脉瓣关闭不全（P299）舒张期主动脉血流反流至左心室，在主动脉瓣第二听诊区（胸骨左缘3肋间）能闻及舒张期高调叹气样杂音，可沿胸骨向胸骨左缘和心尖部（D对）传导。主动脉瓣狭窄杂音向颈部和锁骨上窝（A错）传导。二尖瓣关闭不全（P292）收缩期左心室射出的部分血液经关闭不全的二尖瓣口反流至左心房，在心尖部可闻及全收缩期吹风样杂音。前叶损害时杂音向左腋下或左肩胛下（B错）传导，后叶损害时杂音向胸骨左缘和心底部（C错）传导。三尖瓣关闭不全时收缩期杂音可传至心尖部（E错），三尖瓣狭窄很少见，其杂音亦可传导至心尖部。